属于自然被动免疫是
A. 隐性或显性感染
B. 通过胎盘获得母体的抗体
C. 接种疫苗
D. 注射抗毒素
E. 注射类毒素

正确答案：B。通过胎盘获得母体的抗体